关于克山病，不正确的是
A. 环境低硒、营养素失衡是克山病发生的主要原因
B. 克山病年度发病率有高发年、低发年、平年之区别
C. 北方地区克山病由于多集中在11月至翌年2月
D. 急型克山病多见于成人，但大龄儿童亦是高发人群
E. 所有的潜在型克山病均由急型、亚急型、慢型转变而成

正确答案：E。所有的潜在型克山病均由急型、亚急型、慢型转变而成

解析：本题考查克山病。克山病是一种以心肌变性坏死为主要病理改变的生物地球化学性疾病。其发生的主要原因包括环境低硒、膳食中营养素失衡（A对）、生物感染。克山病年度发病率波动较大，有高发年、低发年、平年之区别（B对），亦可间隔年数不等出现爆发。我国北方地区多集中在11月至翌年2月之间（C对）。克山病的临床表现可分为急型、亚急型、慢型、潜在型克山病。急型克山病多见于成人和大龄儿童（D对），具有起病急、病情危重、变化较快等特点。潜在型克山病可由急型、亚急型、慢型好转而成，但大多数人起病即为潜在型（E错。为本题正确答案）。